下列有关医疗保密的描述明显有误的是
A. 医疗保密在医疗实践中具有特殊重要的作用
B. 孙思邈《大医精诚》中曾明确提及
C. 医学伦理中最古老的医德范畴
D. 《希波克拉底誓言》中曾明确提及
E. 若不保密可能造成对患者的歧视

正确答案：B。孙思邈《大医精诚》中曾明确提及